下列有关《中小学校教室采光照明标准》的描述，哪一条与该标准的实际要求不符
A. 单侧采光时教室的室深系数不应小于1:2
B. 教室窗地面积比不应低于1:5
C. 教室与对面遮挡物的距离应大于该建筑物的2倍高度
D. 教室课桌面照度不低于300lx；照度均匀度多数应达到或接近0.7
E. 黑板面平均照度不低于200lx；照度均匀度应达到或接近1.0

正确答案：E。黑板面平均照度不低于200lx；照度均匀度应达到或接近1.0